可表现为发热伴干性咳嗽的疾病是
A. 胸膜炎
B. 肺炎链球菌肺炎
C. 空洞型肺结核
D. 支气管扩张
E. 喉头水肿

正确答案：A。胸膜炎

解析：可表现为发热伴干性咳嗽的疾病是胸膜炎（A对）。肺炎链球菌肺炎（B错）表现为咳嗽伴咳痰、发热，不表现为干性咳嗽。空洞型肺结核（C错）、支气管扩张（D错）、慢性支气管炎、肺炎、肺脓肿等表现为咳嗽伴咳痰，不表现为干性咳嗽，空洞型肺结核可伴有发热。喉头水肿（E错）可表现犬吠样咳嗽伴呼吸困难。